能消食化积，活血散瘀的药物是
A. 山楂
B. 莱菔子
C. 鸡内金
D. 麦芽
E. 谷芽

正确答案：A。山楂

解析：山楂的功效是消食健胃，行气散瘀，化浊降脂。山楂药性酸甘，微温不热，功善消食化积，能治各种饮食积滞，尤为消化油腻肉食积滞之要药；又性温兼入肝经血分，能通行气血，有活血祛瘀之功（A对）。莱菔子（B错）的功效是消食除胀，降气化痰。鸡内金（C错）的功效是健胃消食，涩精止遗，通淋化石。麦芽（D错）的功效是行气消食，健脾开胃，回乳消胀。谷芽（E错）的功效是消食和中，健脾开胃。